可供静脉注射的胰岛素/胰岛素类似物的是
A. 地特胰岛素
B. 预混胰岛素
C. 普通胰岛素
D. 精蛋白锌胰岛素
E. 低精蛋白锌胰岛素

正确答案：C。普通胰岛素

解析：本题考查胰岛素/胰岛素类似物的分类。普通胰岛素（C对）为可供静脉注射的胰岛素。胰岛素及胰岛素类似物根据胰岛素作用时间分类：（1）超短效胰岛素：门冬胰岛素、赖脯胰岛素，皮下注射吸收较人胰岛素快3倍，起效迅速，持续时间短，能更加有效地控制餐后血糖。（2）短效胰岛素，外观为无色透明溶液，可在病情紧急情况下静脉输注。（3）中效胰岛素：最常见是低精蛋白锌胰岛素。（4）长效胰岛素：最常见的就是精蛋白锌胰岛素。（5）超长效胰岛素：甘精胰岛素和地特胰岛素。（6）预混胰岛素：即“双时相胰岛素”，是指含有两种胰岛素的混合物，可同时具有短效和长效胰岛素的作用。